我国成年人膳食中碳水化合物提供能量占全日摄入总能量的适宜百分比为
A. 40%以下
B. 40%～54%
C. 50%～65%
D. 70%以上
E. 20%～30%

正确答案：C。50%～65%